母婴保健技术服务主要包括
A. 助产技术
B. 产前诊断和遗传病诊断
C. 婚前医学检查
D. 新生儿疾病筛查
E. 以上说法均正确

正确答案：E。以上说法均正确

解析：母婴保健技术服务主要包括下列事项：①有关母婴保健的科普宣传、教育和咨询；②婚前医学检查；③产前诊断和遗传病诊断；④助产技术；⑤实施医学上需要的节育手术；⑥新生儿疾病筛查；⑦有关生育、节育、不育的其他生殖保健服务。掌握“母婴保健法及其实施办法”知识点。